月经规律的妇女，推算预产期常用的时间是
A. 末次月经干净之日
B. 末次月经开始之日
C. 初觉胎动之日
D. 房事之日
E. 早孕反应开始之日

正确答案：B。末次月经开始之日

解析：月经规律的女性推算预产期从末次月经第一日算起，月份减3或加9，日数加7（农历日数加14）（B对A错）。若孕妇不记得末次月经时间，也可根据胎动开始时间（C错）、早孕反应（E错）、B行超声测定胎头双顶径、测量子宫高度等进行推算。房事时间不能算作受孕时间去推算预产期（D错）。